用药剂量过大或体内蓄积过多时发生的危害机体的反应属于
A. 继发性反应
B. 毒性反应
C. 特异质反应
D. 变态反应
E. 副作用

正确答案：B。毒性反应

解析：本题考查药品不良反应的分类。用药剂量过大或体内蓄积过多时发生的危害机体的反应属于毒性反应（B对）。毒性反应是指在药物剂量过大或体内蓄积过多时发生的危害机体的反应。继发性反应（A错）是由于药物的治疗作用所引起的不良后果，又称为治疗矛盾。特异质反应（C错）是指少数特异体质患者对某些药物反应异常敏感。变态反应（D错）是指机体受药物刺激所发生异常的免疫反应，引起机体生理功能障碍或组织损伤，又称为过敏反应。副作用（E错）是指在药物按正常用法用量使用时，出现的与治疗目的无关的不适反应。